泽泻主产地是
A. 浙江
B. 福建
C. 河南
D. 吉林
E. 江苏

正确答案：B。福建

解析：本题考查的是药材泽泻的产地。泽泻主产地是福建（B对）。泽泻：【产地】主产于福建、四川、江西等省。多为栽培品。主产地为浙江（A错）的是浙药。浙药：主产地浙江。如传统的“浙八味”——浙贝母、白术、延胡索、温郁金、玄参、杭白芍、杭菊花、杭麦冬；以及山茱萸、莪术、杭白芷、栀子、乌梅、乌梢蛇等。主产地为河南（C错）的是怀药。怀药：主产地河南。如著名的“四大怀药”——地黄、牛膝、山药、菊花；以及天花粉、瓜蒌、白芷、辛夷、红花、金银花、山茱萸等。主产地为吉林（D错）的药材有人参、五味子、鹿茸等。主产地为江苏（E错）的药材有虎杖、太子参、威灵仙、木通、侧柏叶、紫苏叶、洋金花、地肤子、菟丝子等。